关于中心静脉压（CVP）的意义，下列哪项是错误的
A. CVP的正常值为5～10cmH₂O
B. 在低血压情况下，CVP低于5cmH₂O时，表示心功能不全
C. 在低血压情况下，CVP低于5cmH₂O时，表示血容量不足
D. 高于15cmH₂O时，提示心功能不全
E. 高于20cmH₂O时，则表示有充血性心力衰竭

正确答案：B。在低血压情况下，CVP低于5cmH₂O时，表示心功能不全

解析：中心静脉压（CVP）：CVP的正常值为5～10cmH₂O。在低血压情况下，CVP低于5cmH₂O时，表示血容量不足，高于15cmH₂O时，提示心功能不全、静脉血管床过度收缩或肺循环阻力增加；高于20cmH₂O时，则表示有充血性心力衰竭。为取得可靠结果，应作连续测定，进行动态观察。掌握“休克”知识点。